外照射急性放射病依据身体吸收剂量，临床上分为的3型分别是
A. 骨髓型、肝肾型、脑干型
B. 骨髓型、肝肾型、皮肤型
C. 骨髓型、胃肠型、皮肤型
D. 骨髓型、胃肠型、肝肾型
E. 骨髓型、肠型、脑型

正确答案：E。骨髓型、肠型、脑型

解析：本题考查外照射急性放射病依据身体吸收剂量的分型。外照射急性放射病依据身体吸收剂量，临床上分为的3型分别是骨髓型、肠型、脑型（E对ABCD错）。